男，16岁，发热4天伴纳差2天急诊。检查：血压114/70mmHg，左脚拇趾甲沟部红肿破溃，血白细胞计数为20×10⁹/L，中性粒细胞为89%。初步诊断是
A. 左拇趾甲沟炎
B. 左中趾坏疽
C. 左侧小腿丹毒
D. 左小腿蜂窝织炎
E. 感染性休克

正确答案：A。左拇趾甲沟炎

解析：该患者左脚拇指甲沟部红肿破溃，白细胞及中性粒细胞升高，提示为左拇指甲沟部感染——甲沟炎。甲沟炎是皮肤沿指甲两侧形成的甲沟及其周围组织的化脓性细菌感染，开始表现为局部的红、肿、热、痛，化脓后感染加重，常伴有疼痛的加剧和发热等全身症状（A对）。左拇指坏疽（B错）应表现为左拇指黑色、干燥、皱缩坏死。患者病变在脚趾，与小腿无关（CD错）。感染性休克（E错）主要表现为外周循环受阻，血压下降。